下列检查结果支持CML急变期的是
A. 血中原粒细胞＞5%
B. 血中原粒+早幼粒细胞＞20%
C. 骨髓中原粒细胞＞20%
D. 骨髓中原粒细胞+早幼粒细胞＞50%
E. 骨髓活检显示胶原纤维显著增生

正确答案：D。骨髓中原粒细胞+早幼粒细胞＞50%

解析：急变期是慢粒的终末期，实验室变化指标为外周血中原粒+早幼粒细胞＞30%（AB错），骨髓中原始细胞或原淋+幼淋或原单+幼单＞20%，原粒+早幼粒细胞＞50%（D对C错），出现髓外原始细胞浸润。骨髓活检显示胶原纤维显著增生（P578）（E错）为慢粒加速期的表现。